根尖周肉芽肿内上皮大多数可能来源于
A. Serres上皮剩余
B. Malasssez上皮剩余
C. 口腔粘膜上皮
D. 呼吸道上皮
E. 牙周袋壁上皮

正确答案：B。Malasssez上皮剩余

解析：根尖肉芽肿内的另一个重要特征是有上皮存在，其上皮绝大多数来自牙周膜的Malassez上皮剩余。少数病例也可来自：①口腔上皮，见于有瘘管口和口腔相通的病例，上皮可经瘘道长入，另一情况是牙周病患者，上皮可由牙周袋或受累的根分叉上皮增生而来；②呼吸道上皮，见于病变和上颌窦相通时。掌握“急慢性根尖周炎”知识点。